既能舒肝理气，又能和中化痰的药物是
A. 乌药
B. 青皮
C. 枳壳
D. 佛手
E. 沉香

正确答案：D。佛手

解析：佛手的功效是疏肝理气，和胃止痛，燥湿化痰（D对）。乌药（A错）的功效是行气止痛，温肾散寒。青皮（B错）的功效是疏肝破气，消积化滞。枳壳（C错）的功效是破气消积，化痰除痞。沉香（E错）的功效是行气止痛，温中止呕，纳气平喘。